疱疹样口炎的特征是
A. 一般1～5个溃疡，直径2～4mm，多发生于唇颊黏膜
B. 多为单个大溃疡，直径超过1cm，多发于颊，软腭等处
C. 数目多少，直径大小变化很大，可见明显的局部刺激因素
D. 溃疡单发，病程长，呈潜掘状
E. 多发溃疡可达几十个，直径1～2mm，亦可融合成片，多见于口底、舌腹黏膜

正确答案：E。多发溃疡可达几十个，直径1～2mm，亦可融合成片，多见于口底、舌腹黏膜

解析：本题考查疱疹样口炎的特征。疱疹样口炎的病损特点是：1.成簇小水疱，疱破后成为大片表浅溃疡。2.损害遍及口腔黏膜各处包括牙龈、上腭、舌、颊和唇黏膜。病损表现为多达几十个的溃疡，直径1～2mm，亦可融合成片，损害遍及口腔黏膜各处，多见于口底、舌腹黏膜（E对）。疱疹样口炎由Ⅰ型单纯疱疹病毒引起而不是由局部刺激因素导致。轻型复发性阿弗他溃疡的特征是1～5个溃疡，直径2～4mm，多发生于唇颊黏膜（A错）。重型复发性阿弗他溃疡的特征是单个大溃疡，直径超过1cm，多发于颊，软腭等处（B错）。创伤性溃疡数目多少，直径大小变化很大，可见明显的局部刺激因素（C错）。